适用于高血压病伴肾功能不良的药物是
A. 卡托普利
B. 利舍平
C. 哌唑嗪
D. 氢氯噻嗪
E. 甲基多巴

正确答案：A、C、D、E。卡托普利；哌唑嗪；氢氯噻嗪；甲基多巴